大补阴丸的功能
A. 滋肾补阴
B. 滋阴降火
C. 补肾益精
D. 补养气血

正确答案：B。滋阴降火

解析：本题考查大补阴丸的功能。大补阴丸的功能滋阴降火（B对）。大补阴丸【功能】滋阴降火。左归丸【功能】滋肾补阴（A错）。五子衍宗丸（片、口服液）【功能】补肾益精（C错）。当归补血口服液（丸、胶囊）【功能】补养气血（D错）。杞菊地黄丸（片、浓缩丸、口服液、胶囊）【功能】滋肾养肝（E错）。